嘌吟环中的N7来源于
A. AlA
B. Asp
C. GIn
D. Glu
E. Gly

正确答案：E。Gly